在接近牙髓的牙本质表面或已暴露的牙髓创面上，覆盖牙髓组织恢复的制剂，以保护牙髓的方法称为
A. 根尖诱导成形术
B. 牙髓切断术
C. 盖髓术
D. 牙拔除术
E. 根尖倒充术

正确答案：C。盖髓术

解析：盖髓术，即在接近牙髓的牙本质表面或已暴露的牙髓创面上，覆盖能使牙髓组织恢复的制剂，以保护牙髓，消除病变。掌握“盖髓术”知识点。